为前药，在体内经代谢后产生活性的苯氧羧酸的调血脂药物是
A. 瑞舒伐他汀钙
B. 洛伐他汀
C. 吉非罗齐
D. 非诺贝特
E. 氟伐他汀钠

正确答案：D。非诺贝特

解析：本题考查非诺贝特。非诺贝特（D对）是前药，体内代谢产物为非诺贝特酸，非诺贝特酸为苯氧羧酸类药物。瑞舒伐他汀（A错）非前药，含药物药效基团；洛伐他汀（B错）是前药，不过其体内代谢后有活性的产物为3，5-二羟基戊酸；吉非贝齐（C错）非前药，含药效基团苯氧乙酸；氟伐他汀钠（E错）是将内酯环打开与钠离子成盐的他汀类调血脂药物。